合并冠状动脉痉挛性心绞痛的高血压患者宜首选
A. β受体阻滞剂
B. 利尿剂
C. 血管紧张素转换酶抑制剂
D. 钙通道阻滞剂
E. α受体阻滞剂

正确答案：D。钙通道阻滞剂

解析：钙通道阻滞剂（P225）（D对）可扩张冠状动脉，解除冠状动脉痉挛，改善心内膜下心肌的供血；也可扩张周围血管，降低动脉压，减轻心脏负荷。因此合并冠状动脉痉挛性心绞痛的高血压患者宜首选钙通道阻滞剂。β受体阻滞剂（A错）为轻中度高血压患者的首选抗高血压药物，尤其适用于伴有冠心病（劳累型心绞痛、心肌梗死后）、慢性心力衰竭、交感神经活性增高以及高动力状态的高血压患者（实用内科学第14版P1503）。利尿剂（B错）适用于单纯收缩期高血压、盐敏感性高血压、合并肥胖或糖尿病、合并心力衰竭的患者。血管紧张素转换酶抑制剂（C错）尤其适用于以下情况：伴慢性心力衰竭、糖尿病或非糖尿病肾病、代谢综合征、蛋白尿或微量白蛋白尿患者（实用内科学第14版P1507）。用于抗高血压治疗的α受体阻滞剂（E错）主要为α₁受体阻滞剂，如哌唑嗪、特拉唑嗪等，因其副作用较多，目前不主张单独使用。